轻、中度佝偻病后遗症期X线表现
A. 干骺端增厚，钙化带模糊或消失，呈毛刷样杯口状改变
B. 钙化带重新出现，致密增厚
C. 骨骼无明显改变
D. 长骨短曲和弯曲，干骺端变宽，呈喇叭口状，轮廓光整
E. 长骨钙化预备带密度增加，骨皮质增厚及骨硬化

正确答案：C。骨骼无明显改变

解析：后遗症期多见于3岁以后小儿，临床症状消失，血生化及骨骼X线检查正常，仅遗留不同程度的骨骼畸形，轻、中度佝偻病治疗后很少留有骨骼改变。掌握“维生素D缺乏性佝偻病”知识点。